非二氢吡啶类钙通道阻滞剂（CCB）扩张血管强度弱于二氢吡啶类CCB，但具有负性频率、负性传导和降低交感神经活性作用。临床可用于治疗心律失常、心绞痛、高血压。属于该类药物的是
A. 硝苯地平
B. 拉西地平
C. 非洛地平
D. 氨氯地平
E. 地尔硫䓬

正确答案：E。地尔硫䓬

解析：本题考查非二氢吡啶类钙离子通道阻滞剂。非二氢吡啶类钙离子通道阻滞剂包括地尔硫䓬（E对）、维拉帕米。